成人失血500～800ml，首先考虑输入
A. 全血
B. 血浆
C. 浓缩红细胞
D. 白蛋白
E. 晶体液

正确答案：E。晶体液

解析：成人失血500～800ml（约占总血容量的10%～16%），首先考虑输入晶体液（E对），补充总血容量。若失血量超过总血容量的20%（1000ml）时，此时，除输入晶体液或胶体液补充血容量外，还应考虑输入浓缩红细胞（CRBC）（C错）以提高携氧能力。当失血量达总血容量的30%以上时，才输入全血（A错）和浓缩红细胞各半，再配合晶体和胶体液及血浆（B错）以补充血容量。当失血量超过50%时，如发现有白蛋白（正常值35～50g/L）缺乏，或有低白蛋白血症伴有腹水者，才考虑输入白蛋白（D错）。